支配眼轮匝肌的神经是
A. 面神经颞支和颧支
B. 面神经的颧支
C. 三叉神经的眼神经
D. 面神经颞支
E. 无

正确答案：A。面神经颞支和颧支

解析：支配眼轮匝肌的神经是面神经颞支和颧支（A对BD错）。三叉神经的眼神经（C错）传导头面部、眼鼻部分皮肤黏膜的感觉。